肺心病急性加重期治疗的关键是
A. 抢救呼吸衰竭
B. 控制心衰
C. 防止肺性脑病
D. 控制呼吸道感染
E. 持续低流量吸氧

正确答案：D。控制呼吸道感染

解析：肺心病治疗原则为积极控制呼吸道感染，通常呼吸道，改善呼吸功能，纠正缺氧和二氧化碳潴留，控制呼吸衰竭和心力衰竭，防治肺性脑病、酸碱失衡及电解质紊乱等并发症。由于呼吸道感染是肺心病加重的主要原因，故控制呼吸道感染（D对）为肺心病急性加重期治疗的关键。